喹诺酮类药物与三环类抗抑郁药联合应用，会导致增加的风险是
A. 消化道出血
B. 牙龈增生
C. 肌腱断裂
D. Q-T间期延长
E. 间质性肺炎

正确答案：D。Q-T间期延长

解析：本题考查喹诺酮类药物典型不良反应与禁忌。喹诺酮类药物与三环类抗抑郁药联合应用，会导致Q-T间期延长（D对）的风险增加。